在有可能发生药物的物理或化学配伍时应采取的处理方法有
A. 改变溶剂
B. 改变调配顺序
C. 添加助溶剂
D. 改变溶液的pH值
E. 改变有效成分或剂型

正确答案：A、B、C、D、E。改变溶剂；改变调配顺序；添加助溶剂；改变溶液的pH值；改变有效成分或剂型

解析：本题考查药物的配伍变化。 配伍变化的处理方法包括： （1）改变贮存条件；（2）改变调配次序（B对）；（3）改变溶剂（A对）或添加助溶剂（C对）；（4）调整溶液pH（D对）；（5）改变有效成分或改变剂型（E对）。